孕妇自觉胎动停止，子宫停止增长，检查胎心听不到，子宫比妊娠周数小
A. 可能是胎儿太小
B. 可能是胎儿心跳太弱
C. 可考虑为死胎
D. 孕妇身体太弱
E. 医生检查的问题

正确答案：C。可考虑为死胎